生物学宽度由以下哪些结构组成
A. 结合上皮的冠根向宽度+骨嵴顶冠方的结缔组织
B. 结合上皮的冠根向宽度+龈沟深度
C. 结合上皮宽度十龈沟深度+骨嵴顶冠方的结缔组织
D. 探诊深度+骨嵴顶冠方的结缔组织
E. 探诊深度减龈沟深度

正确答案：A。结合上皮的冠根向宽度+骨嵴顶冠方的结缔组织

解析：本题考查生物学宽度。生物学宽度包括结合上皮及结合上皮的根方（即结合上皮的冠根向宽度）和牙槽嵴顶之间（即骨嵴顶冠方）的纤维结缔组织（A对）。生物学宽度对于指导冠延长术具有重要意义。